眶下沟位于
A. 上颌骨体内侧面
B. 上颌骨体上面
C. 上颌骨的颞下面
D. 上颌骨牙槽突
E. 上颌骨腭突

正确答案：B。上颌骨体上面

解析：眶下沟位于上颌骨体上面（B对）。上颌体内含上颌窦，分前面、颞下面、眶面及鼻面 。 前面上份有眶下孔, 孔下方凹陷，称尖牙窝 。 颞下面朝向后外，中部有小的牙槽孔 。 眶面构成眶的下壁，有矢状位的眶下沟，向前下连于眶下管 。 鼻面构成鼻腔外侧壁，后份有大的上颌窦裂孔，通入上颌窦，前份有纵行的泪沟（A错）。